虎杖的主治病证不包括
A. 跌打损伤
B. 肝郁胁痛
C. 湿热黄疸
D. 毒蛇咬伤
E. 肺热咳嗽

正确答案：B。肝郁胁痛

解析：本题考查虎杖的主治病证。虎杖的主治病证不包括肝郁胁痛（B错，为本题正确答案）。虎杖【主治病证】（1）湿热黄疸（C对），淋浊，带下。（2）水火烫伤，疮痈肿毒，毒蛇咬伤（D对）。（3）闭经，痛经，癥瘕，跌打损伤（A对），风湿痹痛。（4）肺热咳嗽（E对）。（5）热结便秘。（6）肝胆及泌尿系结石症。